属于《药品经营许可证》许可事项的变更，不需重新办理《药品经营许可证》的是
A. 改变药品经营企业注册地址
B. 更换药品经营企业采购负责人
C. 改变药品经营方式
D. 改变药品经营企业组织架构

正确答案：A。改变药品经营企业注册地址

解析：本题考查的是药品经营许可证变更。属于《药品经营许可证》许可事项的变更，不需重新办理《药品经营许可证》的是改变药品经营企业注册地址（A对）。药品经营许可证变更：（1）变更分类：药品经营许可证变更分为许可事项变更和登记事项变更。许可事项变更是指注册地址、主要负责人、质量负责人、经营范围、仓库地址（包括增减仓库）的变更（BD错）。登记事项变更是指企业名称、社会信用代码、法定代表人等事项的变更。（2）许可事项变更：药品经营企业变更许可事项的，应当向原发证机关提交药品经营许可证变更申请及相关材料。原发证机关应当自受理企业变更申请之日起15个工作日内作出准予变更或不予变更的决定。需现场检查的，原发证机关依据检查细则相关内容组织现场检查。现场检查、企业整改的时间，不计入审批时限。未经批准，企业不得擅自变更许可事项。药品经营企业如未经原发证机关许可，擅自变更药品经营许可证经营范围、仓库地址（包括增加仓库）、注册地址的，依照《药品管理法》第一百一十五条给予处罚。（3）登记事项变更：药品经营企业变更登记事项的，应当在市场监督管理部门核准变更后30日内，向原发证机关提交药品经营许可证变更申请。原发证机关应当自受理企业变更申请之日起10个工作日内完成变更事项。企业分立、新设合并、改变经营方式（C错）、跨原管辖地迁移，按照新开办药品经营企业申领药品经营许可证。药品零售连锁经营企业收购、兼并其他药品零售企业时，如实际经营地址、经营范围未发生变化的，可按变更药品经营许可证办理。